肾功能不全时，药物代谢和排泄会受到影响。关于肾功能不全患者用药基本原则和注意事项的说法，正确的有
A. 根据治疗情况及时调整剂量或更换治疗药物
B. 尽量不用可能导致肾功能损害的药物
C. 坚持少而精的用药原则
D. 部分中药有特殊煎煮时间要求应合理选择煎煮时间
E. 多种药物联用时应注意药物相互作用避免产生新的肾损害

正确答案：A、B、C、E。根据治疗情况及时调整剂量或更换治疗药物；尽量不用可能导致肾功能损害的药物；坚持少而精的用药原则；多种药物联用时应注意药物相互作用避免产生新的肾损害

解析：本题考查的是肾功能不全者用药基本原则和注意事项。肾功能不全时，药物代谢和排泄会受到影响。关于肾功能不全患者用药基本原则和注意事项的说法，正确的有根据治疗情况及时调整剂量或更换治疗药物（A对）、尽量不用可能导致肾功能损害的药物（B对）、坚持少而精的用药原则（C对）与多种药物联用时应注意药物相互作用避免产生新的肾损害（E对）。肾功能不全者用药基本原则和注意事项：1.明确疾病诊断和治疗目标：在治疗时，首先应明确疾病诊断，对疾病的病理生理过程及现状作出准确的分析，合理选择药物，既要针对适应证，又要排除禁忌证；接着应明确治疗需要达到的目标，是治标或治本，还是标本同冶。治疗一段时间后，观察目标是否达到，以确定用药是否合理，是否需要调整，避免盲目用药。2.忌用有肾毒性的药物：肾脏是药物排泄的主要途径，肾功能不全者用药更应谨慎，对可能致肾损害的药物应尽量不用；凡必须用者，应尽最采用肾损害较小的药物来替代，可短期或交替使用，切不可滥用。3.注意药物相互作用，避免产生新的肾损害：凡同时服用多种药物者，要注意药物间的相互作用，警惕药物间的代谢产物形成新的肾损害。许多情况下，要明确肯定中药特别是复方的肾损害作用常很困难。在某些病例中，把肾损害作用完全归于某一药物，恐怕也不完全符合事实。所以，作为执业药师应熟知哪些药物能引起肾损害，其主要临床表现及病理改变如何，对于预防和发现药源性肾损害十分重要。4.坚持少而精的用药原则：肾功能不全者，往往出现多种并发症或合并其他疾病，可出现各种各样的临床症状和表现，治疗时应祛邪扶正并举，这在肾衰治疗中尤其重要。治疗中一定要对患者的疾病状态做一个全面的分析，选用少数几种切实有效的药物进行治疗。5.定期检查，及时调整治疗方案：对待肾功能不全者应始终负责，在治疗中必须严密观察病程发展、肾功能变化及药物不良反应的出现，及时调整剂量或更换治疗药物。一般情况下，如按肾功能损害程度递减药物剂量或延长给药间隔时间，可避免一般肾毒性药物对肾脏的进一步损害。部分中药有特殊煎煮时间要求应合理选择煎煮时间（D错）属于中药引起肾损伤的防治原则。中药引起肾损伤的防治原则：预防药物性肾损伤，首先要严格掌握各种药物应用的适应证，避免滥用。其次也应注意下述事项。1.药物应用中注意剂量、疗程，用药期间严密监测尿酶、尿蛋白及肾功能。对某些有肾损害高危因素者，药物应慎用或减量。如婴幼儿、营养状况差、肾功能不全者，应尽量避免使用本类药物；必须要用的，应根据具体情况减量或延长给药间隔时间。2.数种药物并用时，注意药物间的相互作用。3.部分中草药有特殊煎煮时间要求，如山豆根煎煮时间越长，则毒性作用越强。因此应搞清不同中草药的煎煮时间。同时煎煮器具选择不当，也可致毒，应避免用铝锅、铁锅煎药。4.如果因慢性病需长期服用某类中药，对有蓄积可能的药物，应采用少量、间断服药的方法。含金属矿石成分的中药一般排泄极为缓慢，不但一次用量要严格控制，若长期服用，即使小剂量也易蓄积致肾损害。5.一旦发现有肾损害，应立即停药，根据不同药物种类及其临床表现给予相应处理。